味辛、苦，性温，既行气宽中，又燥湿化痰，发表散寒的药是
A. 香橼
B. 甘松
C. 化橘红
D. 橘红
E. 枳壳

正确答案：D。橘红

解析：本题考查的是橘红的性味归经与功效。味辛、苦，性温，既行气宽中，又燥湿化痰，发表散寒的药是橘红（D对）。橘红：【性味归经】辛、苦，温。归肺、脾经。【功效】行气宽中，燥湿化痰，发表散寒。香橼（A错）：【性味归经】辛、苦、酸，温。归肝、脾、肺经。【功效】疏肝理气，和中化痰。甘松（B错）：【性味归经】辛、甘，温。归脾、胃经。【功效】行气止痛，开郁醒脾。化橘红（C错）：【性味归经】辛、苦，温。归肺、脾、胃经。【功效】理气宽中，燥湿化痰，消食。枳壳（E错）：【性味归经】苦、辛，微寒。归脾、胃、大肠经。【功效】理气宽中，行滞消胀。